用于急性心肌梗死和顽固性充血性心力衰竭的α受体阻滞药是
A. 普萘洛尔
B. 哌唑嗪
C. 酚妥拉明
D. 肾上腺素
E. 利血平

正确答案：C。酚妥拉明

解析：酚妥拉明通过阻断α受体以及对血管的直接舒张作用而使血管扩张，血压下降。临床应用于①外周血管痉挛病②静滴去甲肾上腺素药液外漏③急性心肌梗死和顽固性充血性心力衰竭（C对）④休克⑤肾上腺嗜铬细胞瘤。